修复体应力集中处易折断、表面有砂眼等情况，属于
A. 外伤
B. 制作因素
C. 材料因素
D. 磨耗过多
E. （牙合）力过大

正确答案：B。制作因素

解析：制作因素，如局部棱角锐边，应力集中处易折断以及铸造修复体表面砂眼等。掌握“修复体戴入后的问题及处理”知识点。